职业病诊断鉴定费用由谁来承担
A. 用人单位
B. 政府
C. 申请鉴定人
D. 用人单位和职业病患者共同
E. 职业病患者

正确答案：A。用人单位